检查盐酸美他环素中的土霉素，采用
A. 比色法
B. 比浊法
C. 在490mm处测定吸收度的方法
D. 高效液相色谱法
E. 薄层色谱法

正确答案：D。高效液相色谱法